关于饮食禁忌的表述，错误的是
A. 寒性病者忌食生冷
B. 热性病者忌食辛热油腻
C. 皮肤病者忌食腥膻发物
D. 外感表证者忌食油腻类食品
E. 胸痹心痛者忌食辛香类食品

正确答案：E。胸痹心痛者忌食辛香类食品